关于致癌强度系数，不正确的是
A. 它是指一个个体终生（70年）暴露于某一致癌物后发生癌症的概率的95%上限估计值，其单位以[mg/（kg·d）]⁻¹表示
B. 终生暴露于剂量为每日每公斤体重1mg致癌物时的终生超额患癌危险度，其值为剂量-反应曲线斜率的95%上限，以[mg/（kg·d）]表示。
C. 它是指一个个体终生（70年）暴露于某一致癌物后发生癌症的概率的90%上限估计值，其单位以[g/（kg·d）]表示
D. 致癌强度系数可因暴露途径不同而异
E. 此值越大，则单位剂量致癌物的致癌概率越高

正确答案：C。它是指一个个体终生（70年）暴露于某一致癌物后发生癌症的概率的90%上限估计值，其单位以[g/（kg·d）]表示

解析：本题考查致癌强度系数的相关内容。致癌强度系数是指一个个体终生（70年）暴露于某一致癌物后发生癌症的概率的95%上限估计值，其单位以[mg/（kg·d）]⁻¹（A对）表示（C错，为本题正确答案）。此值越大，则单位剂量致癌物的致癌概率越高（E对）。致癌强度系数可因暴露途径不同而异（D对），终生暴露于剂量为每日每公斤体重1mg致癌物时的终生超额患癌危险度，其值为剂量-反应曲线斜率的95%上限，以[mg/（kg·d）]表示（B对）。